带状疱疹的致病病原微生物是
A. 细菌
B. 真菌
C. 衣原体
D. 支原体
E. 病毒

正确答案：E。病毒

解析：本题考查带状疱疹的致病病原微生物。病毒（E对）是带状疱疹的致病病原微生物。带状疱疹是由水痘-带状疱疹病毒所引起的，以沿单侧周围神经分布的簇集性小水疱为特征，常伴有明显的神经痛。真菌（B错）中的念珠菌属一些致病菌种可引起原发或继发感染口腔念珠菌病。细菌（A错）中的结核分枝杆菌可侵犯黏膜引起慢性感染口腔结核，还有其他细菌可引起球菌性口炎、坏死性龈口炎等。衣原体（C错）、支原体（D错）感染可出现口腔溃疡。